下列不属于国家基本公共卫生服务规范服务内容的是
A. 居民健康教育
B. 预防接种
C. 孕产妇健康管理
D. 高血压患者健康管理
E. 恶性肿瘤患者康复

正确答案：E。恶性肿瘤患者康复